《中国药典》定义，“无引湿性”系指药物的引湿增重小于
A. 0.002
B. 0.005
C. 0.01
D. 0.001
E. 0.02

正确答案：A。0.002

解析：本题考查药品标准质量要求。《中国药典》定义，“无引湿性”系指药物的引湿增重小于0.2%（A对）。药物的引湿性是指在一定温度及湿度条件下该物质吸收水分能力或程度的特性。引湿性特征描述与引湿性增重的界定如下：①潮解：吸收足量水分形成液体；②极具引湿性：引湿增重不小于15%；③有引湿性：引湿增重小于15%但不小于2%；④略有引湿性：引湿增重小于2%但不小于0.2%；⑤无或几乎无引湿性：引湿增重小于0.2%。